确定糖连接顺序的方法有
A. 缓和水解法
B. FAB-MS法
C. 2D-NMR法
D. 冷处理法
E. 热处理法

正确答案：A、B、C。缓和水解法；FAB-MS法；2D-NMR法

解析：本题考查的是确定糖连接顺序的方法。确定糖连接顺序的方法有缓和水解法（A对）、FAB-MS法（B对）、2D-NMR法（C对）。缓和水解法：即用稀酸（包括有机酸）水解、酶解、乙酰解、碱水解等方法，将苷的糖链水解成较小的片段（各种低聚糖），然后分析这些低聚糖的连接顺序，从低聚糖的结构推测整个糖链的结构。2D-NMR和NOE差谱技术：可判断糖与苷元及单糖之间的连接顺序。FD-MS和FAB-MS均适于强心苷分子量和糖连接顺序的测定，是目前在对强心苷进行MS测定时常用的技术。